诊断甲状腺功能亢进最有意义的体征是
A. 心率增快，第一心音亢进
B. 双手指细颤
C. 浸润性突眼
D. 脉压增大
E. 弥漫性甲状腺肿大伴血管杂音

正确答案：E。弥漫性甲状腺肿大伴血管杂音

解析：弥漫性甲状腺肿大伴血管杂音为甲状腺功能亢进最有诊断意义的体征（E对）。心音增强，心尖区第一心音亢进（A错）可闻及收缩期杂音为诊断甲亢体征之一，不是最有诊断意义。收缩压上升，舒张压稍降，脉压差增大（D错），有时可出现水冲脉与毛细血管搏动征也不是最有诊断意义的体征。舌、手伸出时可有细震颤（B错），腱反射活跃，反射时间缩短为体征之一。浸润性眼突（C错）也是体征之一。